维生素D缺乏性手足搐搦症的发病机制主要是
A. 甲状腺反应迟钝
B. 甲状旁腺反应迟钝
C. 脑垂体反应迟钝
D. 肾上腺皮质反应迟钝
E. 肾上腺髓质反应迟钝

正确答案：B。甲状旁腺反应迟钝

解析：维生素D缺乏时，血钙下降而甲状旁腺不能代偿性分泌增加;血钙继续降低，当总血钙低于1.75～1.88mm〇l/L（7～7.5mg/dl），或离子钙低于1.0mmol/L（4mg/dl）时可引起神经肌肉兴奋性增高，出现抽搐。因此维生素D缺乏性手足搐搦症的发病机制主要是甲状旁腺反应迟钝（B对）。而甲状腺、脑垂体、肾上腺不参与血钙的调节，所以维生素D缺乏性手足搐搦症的发病机制与甲状腺（A错）、脑垂体（C错）、肾上腺（DE错）的关系不大。